可根据监测凝血酶原时间调整用药剂量的是
A. 氯吡格雷
B. 噻氯匹定
C. 华法林钠
D. 西洛他唑
E. 阿司匹林

正确答案：C。华法林钠

解析：本题考查血生化检查。可根据监测凝血酶原时间调整用药剂量的是华法林钠（C对）。凝血酶原时间用于监测口服抗凝剂的用量，是监测口服抗凝剂的首选指标，如华法林和利伐沙班等。氯吡格雷（A错）、噻氯匹定（B错）、西洛他唑（D错）、阿司匹林（E错）为抑制血小板聚集的药物，不属于口服抗凝剂。